根据五行生克乘侮规律，以下哪种说法是错误的
A. 心火不足，肾水可乘之
B. 木火刑金
C. 肝火乘土
D. 心火亢盛，可反侮肺金
E. 岁土太过，雨湿流行，肾水受邪

正确答案：D。心火亢盛，可反侮肺金

解析：相乘指五行中所不胜一行对其所胜一行的过度制约或克制。五行相乘的次序与相克相同，即木乘土，土乘水，水乘火，火乘金，金乘木。正常情况下，水能克火，火为水之所胜；若水气过于亢盛，对火克制太多，可致火的不足(A对)。肺金本能克制肝木，由于暴怒而致肝火亢盛，太过导致相侮，肺金不仅无力制约肝木，反遭肝火之反向克制，称为“木火刑金”（B对）。木乘土，肝火的绝对亢盛而引起的相乘称为“肝火乘土”（C对）。火为金之所不胜，心火过于亢盛则乘肺金，而不是反侮肺金（D错，为本题正确答案）。土能克水，土的绝对亢盛而引起的相乘，使水受到累及，即“土旺乘水”（E对）。